下列除哪项外，均为细菌生长繁殖的条件
A. 营养物质
B. 酸碱度
C. 温度
D. 气体环境
E. 溶解度

正确答案：E。溶解度

解析：细菌具有独立完成生命活动的能力，可以从周围环境中吸收代谢所需要的营养物质，即水、无机盐、碳源、氮源、生长因子。按细菌对营养物质的需要不同，可将细菌分为自养菌和异养菌。细菌的生长除了满足充足的营养物质外，还需要有适宜的温度、合适的酸碱度（pH）和必需的气体环境。掌握“细菌的生理”知识点。